不属于道义论在医学伦理中的局限性的是
A. 忽视了对患者尽义务与对他人和社会尽义务
B. 难以回答在现代医疗条件下产生的复杂问题
C. 忽视了动机
D. 忽视了医学行为自身价值和后果
E. 忽视了医学道德责任

正确答案：C。忽视了动机

解析：医学道义论忽视了医疗行为动机与效果的辩证统一关系。医学道义论仅注重医务人员对患者尽职尽责的动机，忽视了行为动机与效果的一致性（C错，为本题正确答案）。伦理道义论存在对患者尽义务和对社会尽义务的矛盾（A对）。科学和技术的发展带来的一系列道德难题和医学道德的时代性困境，仅仅以道义论作为理论基础和方法手段同样是十分软弱和无力的（B对）。行为在道德上是否正当合理，不能由其所产生的具体效果来确定，而应当首先看它是否与某种确定的道德原则或道德规范相符（D对）。由于对道德行为全过程的把握不够全面和彻底，它有可能忽视人的需要、目标和派生价值，而走向极端。极端的义务论有可能彻底割断道德与价值的联系（E对）。